30岁男性患者，病程4个月。头痛发病入院前出现左侧肢体无力和呕吐。入院查体：意识清，眼底视乳头水肿，左上下肢肌力Ⅳ级，腱反射活跃，病理征（+）。应采用的检查是
A. X线颅片
B. 脑电图
C. 脑血管造影
D. CT
E. ECT

正确答案：D。CT

解析：患者中年男性，病程4个月，有头痛、呕吐、眼底视乳头水肿等典型的颅内高压表现，且患者已经有因脑组织受压而出现的左上下肢肌力Ⅳ级、腱反射活跃、病理征阳性等大脑皮质运动神经元受损倾向，应考虑病情加重出现脑疝的严重后果，应采用头颅CT（D对）以明确受压程度及部位，为进一步诊疗作出判断依据。X线颅片（A错）只能观察颅骨情况，不能观察脑组织情况。脑电图（B错）用于了解脑功能状态，是癫痫诊断和分类的客观手段，不能观察脑组织情况。脑血管造影（C错）用于判断脑血管病变。ECT（E错）即发射单光子计算机断层扫描，主要用于甲状腺、骨骼等部位肿瘤的检查。